与咬肌前缘相对应的是
A. 上颌结节
B. 磨牙后垫
C. 切牙乳突
D. 远中颊角区
E. 颊棚区

正确答案：D。远中颊角区

解析：本题考查无牙颌的解剖标志。与咬肌前缘相对应的是远中颊角区（D对）。1.远中颊角区黏膜下方是咬肌前缘。2.上颌结节（A错）：是上颌牙槽嵴两侧远端的圆形骨突，深层有颊肌附着，表面黏膜覆盖，其远中为翼上颌切迹。上颌结节与颊黏膜之间形成颊间隙。上颌义齿的颊侧翼缘应充满在此间隙内。颊侧骨突常形成明显倒凹，妨碍基托伸展者需手术去除过凸部分。上颌结节颊侧对应的颊黏膜下方有下颌骨喙突，确定此处全口义齿基托的厚度时，需要考虑上颌结节和喙突之间的距离，不能妨碍下颌的侧方运动。3.磨牙后垫（B错）：位于下颌牙槽嵴远端的黏膜软垫，呈卵圆形，由疏松结缔组织构成，含有黏液腺。下颌全口义齿后缘应盖过磨牙后垫1/2～2/3，以利于义齿的边缘封闭，同时要避免压迫。磨牙后垫位置稳定，是排列人工牙时确定后牙（牙合）平面和颊舌向位置的参考标志。4.切牙乳突（C错）：位于上颌腭中缝的前端，上颌中切牙腭侧的卵圆形的软组织突起。下方为切牙孔，有鼻腭神经和血管通过。切牙乳突与上颌中切牙之间有较稳定的位置关系，中切牙唇面位于切牙乳突中点前8～10mm，上颌两侧尖牙牙尖顶的连线通过切牙乳突中点。切牙乳突位置稳定，是全口义齿排列上颌前牙的重要参考标志。5.颊棚（E错）：位于下颌后弓区，前缘是颊系带，后缘是磨牙后垫和远中颊角区，外界是颊侧前庭沟，内侧是后部牙槽嵴。此区域骨质致密。